关于“绿色交通”，正确的表现包括
A. 发展公共交通，减少个人机动车辆的使用
B. 以最快的速度实现人和物的流动
C. 发展公共交通，尽量减少自行车交通
D. 最大限度地增加机动车辆的使用
E. 以人为本、尽量减少步行

正确答案：A。发展公共交通，减少个人机动车辆的使用

解析：本题考查绿色交通。绿色交通主要表现为减轻交通拥挤、降低环境污染、以人为本、以较低的成本最大限度地实现人和物的流动，如大力发展公共交通，减少个人机动车辆的使用（A对BCDE错），提倡步行与自行车交通，提倡使用清洁燃料等。